可用浓硫酸和重铬酸钾反应区别
A. 莨菪碱和东莨菪碱
B. 小檗碱和麻黄碱
C. 苦参碱和氧化苦参碱
D. 麻黄碱和伪麻黄碱
E. 士的宁和马钱子碱

正确答案：E。士的宁和马钱子碱